菌斑的形成过程中，形成细菌聚集的基础是
A. 葡糖醛酸
B. 蔗糖
C. 葡聚糖
D. 果糖
E. 葡糖基转移酶

正确答案：E。葡糖基转移酶

解析：菌斑的基质由细菌利用蔗糖合成葡聚糖而成，而一些细菌表面结合的葡糖基转移酶（GTF）对葡聚糖有很强的亲和力，从而形成细菌集聚的基础。掌握“龋病概述”知识点。